下列说法哪个错误
A. 视觉语言中枢在优势半球的角回
B. 运动语言中枢在优势半球的额中回后部
C. 听觉中枢在颞横回
D. 左足的一般感觉中枢在旁中央小叶后部
E. 无

正确答案：B。运动语言中枢在优势半球的额中回后部

解析：运动语言中枢在优势半球的额下回后部（B错，为本题正确答案），该中枢主司说话功能，损伤后出现病人能发音却不能说出具有意义的语言，称运动性失语症。视觉语言中枢在优势半球的角回（A对），该中枢与文字的理解和认图密切相关，损伤后可出现视觉无障碍但对原来认识的字不能阅读，也不理解文字符号的意义，称失读症。听觉中枢在颞横回（C对），接受内侧膝状体传入的纤维，每侧的听觉中枢都接受来自两耳的冲动。躯干、四肢的感觉中枢位于中央后回和中央旁小叶后部（第Ⅰ躯体感觉区），其中根据身体各部在该区的投射特点，可知左足的一般感觉中枢在旁中央小叶后部（D对）。